臣药的含义之一是
A. 治疗主证的药
B. 治疗主病的药
C. 助君药治兼证的药
D. 引药直达病所的药
E. 消除君药毒性的药

正确答案：C。助君药治兼证的药

解析：本题考查方剂的组方原则。臣药的含义之一是助君药治兼证的药（C对）。臣药意义有二：一是辅助君药加强治疗主病和主证的药物；二是针对兼病或兼证起治疗作用的药物。它的药力小于君药。君药意义：即对处方的主证（A错）或主病（B错）起主要治疗作用的药物。它体现了处方的主攻方向，其药力居方中之首，是方剂组成中不可缺少的药物。其用量也较臣、佐药大。使药意义有二：一是引经药，即引方中诸药直达病所的药物（D错）；二是调和药，即调和诸药的作用，使其合力驱邪。使药的药力小于臣药，用量亦轻。佐药意义有三：一为佐助药，即协助君、臣药加强治疗作用，或直接治疗次要兼证的药物；二为佐制药，即用以消除或减缓君、臣药的毒性或烈性的药物（E错）；三为反佐药，即根据病情需要，使用与君药药性相反而又能在治疗中起相成作用的药物。佐药的药力小于臣药，一般用量较轻。